不属于嘌呤核苷酸从头合成直接原料是
A. CO₂
B. 甘氨酸
C. 谷氨酸
D. 天冬氨酸
E. —碳单位

正确答案：C。谷氨酸

解析：嘌呤核苷酸从头合成途径是指利用磷酸核糖、氨基酸、一碳单位及CO₂等简单物质为原料，经过一系列酶促反应，合成嘌呤核苷酸。嘌呤核苷酸从头合成直接原料包括天冬氨酸（D错）、谷氨酰胺、甘氨酸（B错）、CO₂（A错）及一碳单位（E错）等，而不包括谷氨酸（C对）。